初产妇，24岁。宫口开全3小时10分钟尚未分娩，此时的诊断是
A. 第二产程停滞
B. 第二产程延长
C. 活跃期停滞
D. 活跃期延长
E. 潜伏期延长

正确答案：B。第二产程延长

解析：青年初产妇，宫口开全（第二产程）3小时10分钟尚未分娩，未实行硬膜外麻醉者，初产妇第二产程最长不应超过3小时，该患者第二产程＞3小时，属于第二产程延长（B对）。